下列属于大腿前群的肌是
A. 股二头肌
B. 股四头肌
C. 半腱肌
D. 半膜肌
E. 股薄肌

正确答案：B。股四头肌

解析：股四头肌（B对）属于大腿肌前群。股二头肌（A错）、半腱肌（C错）和半膜肌（E错）属于大腿肌后群。股薄肌（E错）属于大腿肌内侧群。